乳岩的致病因素，属
A. 外感六淫邪毒
B. 外来伤害
C. 情志内伤
D. 饮食不节
E. 感受特殊之毒

正确答案：C。情志内伤

解析：乳岩的发病是情志失调、饮食失节、冲任不调或先天禀赋不足引起机体阴阳平衡失调、脏腑失和而发病。但情志失调为首要，因为女子以肝为先天，肝主疏泄，性喜条达而恶抑郁，而乳房属肝经，在乳岩的发病中，情志失调，肝失疏泄为主（C对）。外感六淫邪毒，《外科启玄》云：天地有六淫之气，乃风寒暑湿燥火，人感受之则营气不从，变生痈肿疔疖（A错）。外来伤害可引起局部气血凝滞、郁久化热、热胜肉腐等，导致痰血流注、水火烫伤、冻伤、外伤染毒等外伤性疾病（B错）。饮食不节，恣食膏粱厚味、醇酒炙煿或辛辣刺激之品，可使脾胃功能失调，湿热火毒内生，同时感受外邪则易发生痈、有头疽、疔疮等疾病（D错）。特殊之毒包括虫毒、蛇毒、疯犬毒、药毒、食物毒、疫毒，但皆不能发生乳岩（E错）。